治疗顿咳恢复期，应首选
A. 人参五味子汤
B. 华盖散
C. 参附龙牡救逆汤
D. 桑白皮汤
E. 桑菊饮

正确答案：A。人参五味子汤

解析：顿咳恢复期可见痉咳缓解后，咳嗽次数减少，程度减轻，但咳时呈干呛状，容易出汗等肺阴耗伤之证。或出现咳声无力，精神萎靡，食欲不振等伤及脾气之证。治宜润肺健脾，人参五味子汤为选项中最佳选择（A对）。华盖散功能辛温宣肺，化痰止咳，用于肺炎喘嗽之风寒闭肺证（B错）。参附龙牡救逆汤功能温补心阳，救逆固脱，用于肺炎喘嗽之心阳虚衰证（C错）。桑白皮汤功能清肺降气，化痰止嗽，用于顿咳之痉咳期（D错）。桑菊饮功能疏风清热，宣肺止咳，用于风热咳嗽（E错）。